成书最早的的医学著作是
A. 外台秘要
B. 金匮要略
C. 黄帝内经
D. 神农本草经
E. 备急千金要方

正确答案：C。黄帝内经

解析：本题考查的是主要的医学典籍。成书最早的的医学著作是《黄帝内经》（C对）。《黄帝内经》：又称《内经》，是最早的一部中医典籍，也是中医学最重要的经典著作。《外台秘要》（A错）：唐·王焘编撰。该书是继《备急千金要方》后又一部综合性医学巨著，为医学史的研究提供了不少珍贵资料。《金匮要略》（B错），即《金匮要略方论》。《金匮要略方论》：简称《金匮要略》《金匮》。全书以《内经》理论为指导，理论联系实际，开创了内伤杂病辨证论治的体系，对后世临床医学的发展有深远影响。《神农本草经》（D错）：简称《本经》《本草经》《神农本草》。该书是最早的本草学专著，具有重要的科学价值和历史影响，为我国医药学四大经典著作之一。《备急千金要方》（E错）：简称《千金要方》，唐·孙思邈撰著。孙氏首重医德，序例中著有“大医习业”“大医精诚”两篇专论。孙氏集唐以前方书之大成，使之流传后世。